男性，34岁，腹部砸伤4小时，查体见四肢湿冷，腹肌紧张，全腹压痛、反跳痛，有移动性浊音，肠鸣音消失，该病人目前应进行的处理不包括
A. 诊断性腹腔穿刺
B. 密切监测基本生命体征
C. 补充血容量，抗休克治疗
D. 给予止痛和镇静剂
E. 抗感染治疗

正确答案：D。给予止痛和镇静剂

解析：诊断不明确的腹部闭合性损伤患者，禁用止痛剂（D错，为本题正确答案），以免掩盖伤情，延误诊断和治疗。诊断性腹腔穿刺（A对）可以明确腹部脏器损伤的类型，对该患者的诊断具有重要参考价值。密切监测基本生命体征（B对）为基本处理措施。该患者查体见四肢湿冷，移动性浊音阳性，提示腹腔内大量出血，因此应积极补充血容量，防治休克（C对）。闭合性腹部损伤易发生感染，因此应常规进行抗感染治疗（E对）。